关于恒磨牙牙胚的发育特点描述正确的是
A. 从胚胎第4周开始，到胚胎第8个月结束
B. 从胚胎第5周开始，到胚胎第4个月结束
C. 从胚胎第4个月开始，到胚胎第10个月结束
D. 从胚胎第4个月开始，到出生后、1年结束
E. 从胚胎第4个月开始，到出生后第4年

正确答案：E。从胚胎第4个月开始，到出生后第4年

解析：本题考查恒磨牙牙胚的发育特点。关于恒磨牙牙胚的发育特点描述正确的是从胚胎第4个月开始，到出生后第4年（E对）。恒磨牙牙胚发育特点是：在乳磨牙牙胚形成之后，牙板的远中端随着上下颌弓的扩展继续向远中生长,其后方的游离端继续形成恒磨牙牙胚，持续到出生后第4年，整个时期长达5年的时间。其中，第一磨牙的牙胚在胚胎第4个月时形成（B错）；第二恒磨牙的牙胚在出生1年后形成；第三恒磨牙牙胚在4～5岁形成（ACD错）。